属于神经氨酸酶抑制剂的非核苷类抗病毒药是
A. 氟尿嘧啶
B. 金刚乙胺
C. 阿昔洛韦
D. 奥司他韦
E. 拉米呋啶

正确答案：D。奥司他韦

解析：本题考查非核苷类抗病毒药。奥司他韦（D对）是作用于神经氨酸酶的抗流感病毒药物，通过抑制NA（去甲肾上腺素），能有效地阻断流感病毒的复制过程，对流感的预防和治疗发挥重要的作用。氟尿嘧啶（A错）为嘧啶类抗代谢物；阿昔洛韦（C错）为开环核苷类抗病毒药物；拉米夫定（E错）是双脱氧硫代胞苷化合物。